不属于液体制剂的是
A. 洗剂
B. 涂剂
C. 涂膜剂
D. 贴膏剂
E. 搽剂

正确答案：D。贴膏剂

解析：本题考查液体制剂。不属于液体制剂的是贴膏剂（D错，为本题正确答案）。贴膏剂系指药材提取物和（或）化学药物与适宜的基质和基材制成的供皮肤贴敷，可产生局部或全身作用的一类片状外用制剂。液体制剂按给药途径分类：（1）内服液体制剂：如糖浆剂、乳剂、混悬液、滴剂等；（2）外用液体制剂：①皮肤用液体制剂：如洗剂（A对）、搽剂（E对）、涂剂（B对）、涂膜剂（C对）等；②五官科用液体制剂：如洗耳剂、滴耳剂、滴鼻剂、含漱剂、滴牙剂等；③直肠、阴道、尿道用液体制剂：如灌肠剂、灌洗剂等。